本病的特点是：①全身组织发育不良；②易发生反复感染；③易发生GVHR；④易发生自身免疫病或肿瘤。该病是
A. DiGeorge（先天性胸腺发育不全）
B. SCID（重症联合免疫缺陷病）
C. Wiskott Aldrich综合征
D. 共济失调—毛细血管扩张
E. 慢性肉芽肿病

正确答案：B。SCID（重症联合免疫缺陷病）